治疗脊髓损伤所引起的肌强直的药物是
A. 地西泮
B. 异丙嗪
C. 乙琥胺
D. 氯丙嗪
E. 苯妥英钠

正确答案：A。地西泮

解析：地西泮（A对）属于苯二氮䓬类药物，具有抗焦虑、镇静催眠、抗惊厥、肌肉松弛等作用，可缓解动物的去大脑僵直，也可缓解人类大脑损伤所致的肌肉僵直。异丙嗪（B错）是吩噻嗪类抗组胺药，也可用于镇吐、抗晕动以及镇静催眠。乙琥胺（C错）、苯妥英钠（E错）是抗癫痫药，对神经细胞有膜稳定作用，降低细胞膜的兴奋性，抑制癫痫病灶神经元的高频异常放电及其放电的扩散。氯丙嗪（D错）是抗精神病药，对中枢神经系统有较强的抑制作用，能显著控制活动状态和躁狂状态。